与青霉素的抗菌作用有关的化学结构是
A. 饱和噻唑环
B. 内酰胺环
C. 咪唑环
D. 哌啶环
E. 大环内酯环

正确答案：B。内酰胺环

解析：青霉素类的基本结构是由母核-氨基青霉烷酸和侧链组成，其中母核中的β₂-内酰胺环（B对）是维持抗菌活性的必需结构，可与细菌细胞膜上的青霉素结合蛋白结合，通过抑制细菌细胞壁的合成，使菌体失去渗透屏障而膨胀、裂解，同时借助细菌的自溶酶作用，导致菌体破裂死亡，β₂-内酰胺环被破坏则抗菌活性消失。青霉素类抗菌药结构中不含有饱和噻唑环（A错）、咪唑环（C错）、哌啶环（D错）、大环内酯环（E错）。